抑制雄激素对前列腺素生长的刺激作用
A. 亚叶酸钙
B. 地塞米松
C. 昂丹司琼
D. 氟他米特
E. L-门冬酰胺酶

正确答案：D。氟他米特